男，30岁，间断右下腹痛一年。加重伴腹泻一月，大便每日4-5次，黄色稀便，无黏液脓血，伴低热，体重减轻4kg。既往反复发作肛瘘1年，曾手术治疗。查体：T37.5℃，右下腹轻压痛，肛门视诊可见肛瘘开口，粪隐血（+++），肠镜检查发现回肠末端、回盲瓣多发溃疡，病变间黏膜基本正常。结肠、直肠未见明显异常。最适宜的治疗是
A. 益生菌治疗
B. 抗结核治疗
C. 抗生素治疗
D. 化疗
E. 英夫利昔单抗治疗

正确答案：E。英夫利昔单抗治疗

解析：患者间断右下腹痛、腹泻（黄色稀便，无黏液脓血）、体重减轻，伴低热、肛瘘，肠镜检查发现回肠末端、回盲瓣多发溃疡，病变间黏膜基本正常（P375）。可诊断为克罗恩病。CD治疗重要的是控制炎症反应，活动期可用氨基水杨酸类、糖皮质激素、免疫抑制剂、抗菌药物、生物制剂。因此最适宜的治疗是英夫利昔单抗治疗（E对）。